治风寒咳嗽、痰多气逆宜选用
A. 川贝枇杷露
B. 半夏止咳糖浆
C. 川贝清肺糖浆
D. 二母宁嗽丸
E. 复方枇杷叶膏

正确答案：B。半夏止咳糖浆